危害社会，触犯刑率是
A. 刑事处罚
B. 犯罪行为违法行为
C. 犯罪主体
D. 犯罪客体
E. 刑事责任

正确答案：B。犯罪行为违法行为

解析：危害社会，触犯刑率是犯罪行为违法行为（B对）。刑事处罚是违反刑法，应当受到的刑法制裁，简称刑罚（A错）。犯罪主体是指实施危害社会的行为、依法应当负刑事责任的自然人和单位（C错）。犯罪客体是犯罪构成的要件之一，指刑事法律所保护而为犯罪行为所侵害的社会关系（D错）。刑事责任是指犯罪人因实施犯罪行为应当承担的法律责任，按刑事法律的规定追究其法律责任，包括主刑和附加刑两种刑事责任（E错）。